前牙金属烤瓷冠唇面颈中二分之一定深沟不超过多少
A. 0.5mm
B. 1mm
C. 1.5mm
D. 1.8mm
E. 2.5mm

正确答案：B。1mm

解析：本题考查金属烤瓷冠的牙体预备。前牙金属烤瓷冠唇面颈中二分之一定深沟不超过多少1mm（B对）。过深会引起牙体不适。